影响胎儿和婴儿软骨发育，孕妇及哺乳妇女不宜用
A. 四环素类
B. 喹诺酮类
C. 磺胺类
D. 硝基呋喃类
E. TMP

正确答案：A。四环素类

解析：四环素类对骨骼和牙齿生长的影响：四环素类药物与新形成的骨骼和牙齿中沉积的钙离子结合，造成恒齿永久性棕色色素沉着（俗称牙齿黄染），还可抑制胎儿、婴幼儿骨骼发育。掌握“四环素、多西环素及米诺环素”知识点。